下列哪项不是抗营养因子
A. 果胶
B. 草酸
C. 单宁酸
D. 有机酸
E. 抗胰蛋白酶因子

正确答案：D。有机酸

解析：抗营养因子有很多，已知道抗营养因子主要有蛋白酶抑制剂、植酸、凝集素、芥酸、棉酚、单宁酸、硫苷等。一些抗营养因子对人体健康具有特殊的作用，如大豆异黄酮、大豆皂苷等，这些物质在食用过多的情况下，会对人体的营养素吸收产生影响，甚至会造成中毒。